不包括在现病史中的是
A. 一般情况
B. 主要症状
C. 伴随症状
D. 诊治经过
E. 父母兄妹是否有同样疾病

正确答案：E。父母兄妹是否有同样疾病

解析：现病史是病史的主体部分，它记述患者患病后的全过程，即发生、发展、演变和诊治经过，包括以下内容：（1）起病情况与患病时间；（2）主要症状（B对）及伴随症状（C对）；（3）病因和诱因；（4）病情的发展与演变；（5）诊疗经过（D对）；（6）病程中的一般情况（A对）。父母兄妹是否有同样疾病（E错，为本题正确答案）属于家族史的内容。